应用口服避孕药时，应注意
A. 血栓性疾病患者禁用
B. 严重肝功能损害者禁用
C. 诊断不明的生殖器官出血者禁用
D. 胰岛素治疗的糖尿病患者不宜应用
E. 充血性心力衰竭者慎用

正确答案：A、B、C、D、E。血栓性疾病患者禁用；严重肝功能损害者禁用；诊断不明的生殖器官出血者禁用；胰岛素治疗的糖尿病患者不宜应用；充血性心力衰竭者慎用

解析：本题考查口服避孕药的注意事项。口服避孕药的禁忌症有：（1）哺乳期妇女 （2）严重肝功能损害（B对）、肾炎、充血性心力衰竭（E对）、高血压、胰岛素治疗的糖尿病患者（D对）、甲状腺功能亢进、子宫肌瘤、肺结核等病的妇女 （3）妊娠、不明原因阴道出血（C对）、肝脏疾病、血栓性疾病（A对）和激素依赖性肿瘤等（4）择期手术或需要长期卧床者，需要在手术（大手术或需静养不动）的前一个月就停止服用口服避孕药。